急性溶血，诱发DIC的原因是
A. 释放大量蛋白水解酶入血
B. 激活因子Ⅻ
C. 释放组织因子
D. 释放大量磷脂入血
E. 直接激活凝血酶原.

正确答案：D。释放大量磷脂入血

解析：释放大量磷脂入血（D对）是急性溶血，诱发DIC的原因，红细胞膜磷脂可浓缩并局限FVII、FIX、FX及凝血酶原等，生成大量凝血酶，促进DIC的发生。缺血－再灌注可使溶酶体膜破裂，溶酶体内释放大量蛋白水解酶入血（A错）引起细胞自溶。当血液与带负电荷的异物表面（如胶原）接触时，激活因子Ⅻ（B错）。内毒素、白细胞介素-1、肿瘤坏死因子α等可诱导血液中的单核细胞和中性粒细胞释放组织因子（C错），启动凝血，诱发DIC。急性坏死性胰腺炎时，大量胰蛋白酶入血，可直接激活凝血酶原（E错），促进凝血酶生成。